女，50岁。饱餐后饮酒出现上腹部持续疼痛6小时，呈腰背部放射。前屈位可稍缓解，呕吐物为胃内容物，呕吐后不缓解。查体：T37.1℃，P112次/分，R24次/分，BP100/70mmHg。全腹压痛，以上腹为著，可见肌紧张，无反跳痛，Murphy征阴性，肠鸣音2次/分，腹部B超提示：胆囊结石，胰腺肿大，回声减低。治疗6周后，患者出现发热。查体：T39.2℃。上腹可触及一巨大包块，边界不清，压痛（+），不活动。针对包块最适宜的治疗是
A. 禁食、胃肠减压
B. 化疗
C. 内镜下结肠支架植入术
D. 穿刺引流
E. 手术切除

正确答案：D。穿刺引流

解析：患者有胆囊结石（胆道疾病高危因素），饱餐后饮酒（AP常见诱因）出现上腹部持续疼痛，向腰背部放射，呕吐物为胃内容物，呕吐后不缓解（AP特异症状）。全腹压痛，以上腹为著，可见肌紧张，肠鸣音减弱（腹膜炎体征）。轻度发热，脉搏细速、血压下降。胰腺肿大，回声减低（胰腺有水肿）。最有可能的诊断是急性胰腺炎。治疗后，患者出现高热。上腹可触及一巨大包块，边界不清，压痛（+），不活动。可能的原因是胰腺假性囊肿合并感染。假性囊肿<5cm时，6周内约50%可自行吸收；囊肿大时，需穿刺引流（九版内科学P435）。患者包块巨大，因此针对包块最适宜的治疗是穿刺引流（D对）。